青蒿的主治病证是
A. 湿热泻痢
B. 肺热咳嗽
C. 疟疾寒热
D. 肝火目赤
E. 内热消渴

正确答案：C。疟疾寒热

解析：本题考查的是青蒿的主治病证。青蒿的主治病证是疟疾寒热（C对）。青蒿：【主治病证】（1）阴虚发热，骨蒸潮热，虚热兼表。（2）热病后期之夜热早凉，或低热不退。（3）血热疹痒、吐血、衄血。（4）疟疾寒热。（5）暑热外感，暑热烦渴。胡黄连：【主治病证】（1）骨蒸潮热。（2）小儿疳热。（3）湿热泻痢（A错），黄疸。（4）咽痛，疮肿，痔肿便血。地骨皮：【主治病证】（1）阴虚发热，有汗骨蒸，小儿疳热。（2）血热之吐血、衄血、尿血。（3）肺热咳嗽（B错）。（4）内热消渴（E错）。龙胆：【主治病证】（1）湿热下注之阴肿阴痒、带下、阴囊湿疹，湿热黄疸。（2）肝火上炎之头痛目赤（D错）、耳聋胁痛等。（3）高热抽搐，小儿急惊，带状疱疹。